下列除哪项外，均可使用培元补肾法
A. 解颅
B. 五迟
C. 五软
D. 哮喘
E. 肺炎喘嗽

正确答案：E。肺炎喘嗽

解析：解颅、五迟、五软、哮喘均为小儿胎禀不足、肾气虚弱或肾不纳气所致，故可用培元补肾法（ABCD错）。小儿肺炎喘嗽为感受外邪，肺失宣降，肺气闭塞所致，应用止咳平喘法（E对）。